患者，男，62岁，因骨性关节炎，药物治疗效果不佳，关节坏死，拟行人工关节置换术。关于该患者手术时预防性抗菌药物给药时机的说法，正确的是
A. 应在皮肤、黏膜切开前15～30分钟内静脉滴注
B. 应在皮肤、黏膜切开前0.5～1小时内静脉滴注
C. 应在皮肤、黏膜切开前1.5～2小时内静脉滴注
D. 应在皮肤、黏膜切开前2.5～3小时内静脉滴注
E. 应在皮肤、黏膜切开前3～4小时内静脉滴注

正确答案：B。应在皮肤、黏膜切开前0.5～1小时内静脉滴注

解析：本题考虑抗菌药物的使用。关于该患者手术时预防性抗菌药物给药时机的说法，正确的是应在皮肤、黏膜切开前0.5～1小时内静脉滴注（B对）。静脉输注应在皮肤、黏膜切开前0.5～1小时内或麻醉开始时给药，在输注完毕后开始手术，保证手术部位暴露时局部组织中抗菌药物已达到足以杀灭手术过程中污染细菌的药物浓度。万古霉素或氟喹诺酮类等由于需输注较长时间，应在手术前1～2小时开始给药。